库瓦济埃征阳性应考虑的疾病是
A. 胆囊炎
B. 胆石症
C. 胰头癌
D. 肝脓肿
E. 溶血性贫血

正确答案：C。胰头癌

解析：在胰头癌压迫胆总管导致阻塞时，发生明显黄疸，且逐渐加深，胆囊显著肿大，但无压痛，称库瓦济埃征（C对）。